有关脊髓白质的描述哪个是错的
A. 固有束是脊髓内部的联系纤维
B. 薄束和楔束位于脊髓后索，纵贯脊髓全长
C. 来自对侧大脑皮质的纤维在皮质脊髓侧束中下行
D. 脊髓丘脑束传导来自躯干、四肢的痛、温、触、压觉
E. 背外侧束位于后角头的背外侧

正确答案：B。薄束和楔束位于脊髓后索，纵贯脊髓全长

解析：薄束和楔束位于脊髓后索内下行，薄束在第5胸节以下占据后索的全部，在胸4以上只占据后索的内侧部，楔束位于后索的外侧部（B错，为本题正确选项）。